分析和探索未知职业性有害因素的传统方法是
A. 实验研究
B. 临床病例观察
C. 职业流行病学调查
D. 类比法
E. 工程分析法

正确答案：B。临床病例观察